麻仁丸的功能是
A. 润肠通便
B. 泻火通便
C. 理气通便
D. 健脾益气，润肠通便
E. 燥湿健脾，润肠通便

正确答案：A。润肠通便

解析：本题考查的是麻仁丸的功能。麻仁丸的功能是润肠通便（A对）。麻仁丸：【功能】润肠通便。当归龙荟丸：【功能】泻火通便（B错）。通便宁片：【功能】宽中理气，泻下通便（C错）。功能为健脾益气，润肠通便（D错）或燥湿健脾，润肠通便（E错）的中成药，2022年考试指南未明确说明。